便秘冷秘的临床特征是
A. 大便不干，腰膝酸软
B. 大便干结，欲便不得
C. 大便不干，努挣乏力
D. 大便艰涩，手足不温
E. 大便干结，口干口臭

正确答案：D。大便艰涩，手足不温

解析：冷秘的典型临床特征为大便艰涩，手足不温（D对）。大便不干，腰膝酸软为阴虚秘的临床表现（A错）。大便干结，欲便不得为气秘的临床表现（B错）。大便不干，努挣乏力为气虚秘的临床表现（C错）。大便干结，口干口臭为热秘的临床表现（E错）。